医疗机构生产的医院制剂在使用过程中出现新的不良反应，应采取的措施是
A. 继续使用并通知供应商
B. 立即停止使用并主动召回
C. 及时向药品不良反应监测机构报告
D. 立即停止使用并销毁，并向药品监督管理部门报告
E. 立即停止使用、就地封存，并向药品监督管理部门报告

正确答案：C。及时向药品不良反应监测机构报告

解析：本题考查的是药物临床管理。医疗机构生产的医院制剂在使用过程中出现新的不良反应，应采取的措施是及时向药品不良反应监测机构报告（C对）。医疗机构应当建立药品不良反应、用药错误和药品损害事件监测报告制度。医疗机构临床科室发现药品不良反应、用药错误和药品损害事件后，应当积极救治患者，立即向药学部门报告，并做好观察与记录。医疗机构应当按照国家有关规定向相关部门报告药品不良反应，用药错误和药品损害事件应当立即向所在地县级卫生行政部门报告。